女，34岁，有连续3次晚期自然流产史，现妊娠4+月，阴道少量出血，下坠感。检查：阴道少量出血，宫颈口开约2cm，宫体前倾4+月妊娠大小，无宫缩，附件（-）孕妇最可能的诊断是
A. 不全流产
B. 过期流产
C. 早期流产
D. 复发性流产
E. 完全流产

正确答案：D。复发性流产

解析：复发性流产是指习惯性同一性伴侣连续自然流产3次以上者。每次流产多发生在同一妊娠月份，其临床经过与一般流产相同。掌握“自然流产”知识点。